去甲肾上腺素使浦肯野细胞自律性增高是通过
A. 最大复极电位降低
B. 阈电位水平下降
C. If电流增强
D. 膜对Ca²⁺通透性增高
E. Isi电流增大

正确答案：C。If电流增强